引起心电图ST段上抬超过正常范围且弓背向上的疾病是
A. 急性心肌梗死
B. 急性心包炎
C. 陈旧性心肌梗死
D. 慢性心包炎
E. 心室肥厚

正确答案：A。急性心肌梗死

解析：急性心肌梗死可见ST段呈弓背向上抬高，心外膜下心肌损伤时（包括透壁性心肌缺血），ST段呈弓背向上抬高，T波倒置（A对）。急性心包炎ST段呈弓背向下抬高（B错）。陈旧性心肌梗死是急性心肌梗死3～6个月之后，心电图提示ST段及T波恢复正常，残留下坏死性的Q波（C错）。慢性心包炎T波平坦或倒置（D错）。左心室肥大：在R波为主的导联，其ST段呈下斜型压低达0.05mV以上，T波低平、双向或倒置。在以S波为主的导联（如V₁导联）则反而可见直立的T波。右心室肥大：右胸导联（V₁，V₂）T波双相、倒置，ST段压低（E错）。